睾丸内合成睾酮的细胞是
A. 生精细胞
B. 支持细胞
C. 间质细胞
D. 成纤维细胞
E. 肌样细胞

正确答案：C。间质细胞

解析：雄激素主要由睾丸的间质细胞分泌，所以睾丸内合成睾酮的细胞是间质细胞（C对）。生精细胞（A错）经过一系列的过程转变成精子，支持细胞（B错）可以分泌多种生物活性物质如雄激素结合蛋白、抑制素等，成纤维细胞（D错）合成和分泌的是胶原纤维、弹性纤维和网状纤维等，肌样细胞（E错）是围绕在生精小管周围，靠近支持细胞基底部的细胞，其通过旁分泌因子调节支持细胞的功能，在人体出生时就已经不存在，均不能合成睾酮。